某男，55岁，有糖尿病史，口渴引饮，能食与便溏并见，精神不振，四肢乏力；舌质淡，苔薄白，脉细弱。根据治法，应用的方剂是
A. 参苓白术丸加减
B. 金匮肾气丸加减
C. 白虎汤加减
D. 杞菊地黄丸加减
E. 龙胆泻肝丸加减

正确答案：A。参苓白术丸加减

解析：本题考查的是消渴的辨证论治。有糖尿病史，口渴引饮，能食与便溏并见，精神不振，四肢乏力；舌质淡，苔薄白，脉细弱。根据治法，应用的方剂是参苓白术丸加减（A对）。消渴脾胃气虚证：【症状】口渴引饮，能食与便溏并见，或饮食减少，精神不振，四肢乏力。舌淡，苔薄白而干，脉细弱无力。【方剂应用】基础方剂为参苓白术散（莲子肉、薏苡仁、砂仁、桔梗、白扁豆、白茯苓、人参、甘草、白术、山药）加减。金匮肾气丸加减（B错）为口疮脾肾阳虚证的方剂应用。口疮脾肾阳虚证：【症状】口疮疼痛较轻，久难愈合，伴倦怠乏力，腰膝或少腹以下冷痛，小便清；检查见口疮色白或暗，周边淡红或不红。舌淡，苔白，脉沉迟。【方剂应用】基础方剂为附子理中丸（人参、白术、甘草、干姜、附子）合金匮肾气丸（附子、桂枝、熟地黄、山药、茯苓、山茱萸、泽泻、丹皮）加减。白虎汤加减（C错）为中暑阳暑的方剂应用。中暑阳暑：【症状】发热汗多，头痛面红，烦躁，胸闷，口渴多饮，溲赤，或兼见恶寒。舌红少津，脉洪大。【方剂应用】基础方剂为白虎汤（知母、石膏、甘草、梗米）加减。龙胆泻肝丸加减（E错）为不寐肝火扰心证的方剂应用。不寐肝火扰心证：【症状】不寐多梦，甚则彻夜不眠，急躁易怒，伴头晕头胀，目赤耳鸣，口干而苦，不思饮食，便秘溲赤。舌红苔黄，脉弦而数。【方剂应用】基础方剂为龙胆泻肝汤（龙胆、泽泻、木通、车前子、当归、柴胡、生地黄、黄芩、栀子、生甘草）加减。方剂应用为杞菊地黄丸加减（D错）的病证，2022年考试指南未明确说明。